对鉴别是否肾小球源性血尿最有意义的是
A. 全程血尿
B. 合并尿道刺激征
C. 尿潜血阳性
D. 肉眼血尿
E. 变形红细胞血尿

正确答案：E。变形红细胞血尿

解析：肾小球源性血尿是指红细胞通过断裂的肾小球基底膜时，受血管内压力挤压受损，其后通过肾小管各段又受不同渗透压和pH作用，呈现变形红细胞血尿。非肾小球源性血尿主要指肾小球以下部位和泌尿通路上的出血，多因毛细血管破裂引起出血，红细胞不通过肾小球基底膜裂孔，未受到上述过程的影响，表现为均一形态正常红细胞尿。因此，对鉴别是否肾小球源性血尿最有意义的是变形红细胞血尿（E对）。全程血尿（九版诊断学P44）（A错）提示血尿来自肾脏或输尿管。合并尿道刺激症（九版诊断学P45）（B错）即尿频、尿急、尿痛，提示下尿路感染。尿潜血阳性（C错）提示有血红蛋白尿或肌红蛋白尿。肉眼血尿（D错）提示每1000ml尿液中含血液量＞1ml（九版诊断学P303）。